下列关于生长发育阶段性和连续性的说法，错误的是
A. 胎儿和婴幼儿时期发育遵循“头尾发展律”
B. 儿童期和青春期发育遵循“向心律"
C. 青春期性器官的生长突增最早
D. 青春期生长突增的顺序依次为手、前臂和上臂
E. 生长发育有一定的顺序，各部分之间互相衔接

正确答案：C。青春期性器官的生长突增最早